引起手术切口血肿的最主要的原因是
A. 伤口裂开
B. 术前服用阿司匹林
C. 高血压控制不满意
D. 术中止血不彻底
E. 伤口感染继发出血

正确答案：D。术中止血不彻底

解析：引起手术切口血肿的最主要的原因是术中止血不彻底（D对）。伤口裂开（A错）、术前服用阿司匹林（B错）、高血压控制不满意（C错）、伤口感染继发出血（E错）都易引起手术切口血肿，但不是最主要原因。